患者，女，72岁。持续性心房颤动，为预防脑卒中，宜选用的药物是
A. 氯吡格雷
B. 双氯芬酸
C. 华法林
D. 奥美拉唑
E. 阿替普酶

正确答案：C。华法林

解析：本题考查用药选择。华法林（C对）用于预防房颤、心瓣膜疾病或人工瓣膜置换术后引起的血栓栓塞并发症（卒中或体循环栓塞）。氯吡格雷（A错）用于治疗非ST段抬高型急性冠脉综合征（包括不稳定型心绞痛或非Q波心肌梗死）。双氯芬酸（B错）用于急、慢性关节炎症和痛风发作类风湿性关节炎、强直性脊柱关节和脊柱的其他炎性风湿性疾病。奥美拉唑（D错）用于胃溃疡、十二指肠溃疡、应激性溃疡、反流性食管炎和卓-艾综合征（胃泌素瘤）。阿替普酶（E错）用于急性心肌梗死、肺栓塞、缺血性脑卒中。